休克根据病因中医分别称为以下各项，除外
A. 气厥
B. 心厥
C. 血脱
D. 液脱
E. 热厥

正确答案：E。热厥

解析：休克在中医属于“厥证、脱证”范畴，并认为“厥”为急证，“脱”为危证。又根据致邪病因分为气厥（过敏性休克）（A对）、心厥（心源性休克）（B对）、血脱（失血性休克）（C对）、液脱（失液性休克）（D对）（E错，为本题正确答案）。